易引起急性肾衰的药是
A. 异丙肾上腺素
B. 碱羟胺
C. 心得安
D. 去甲肾上腺素
E. 多巴胺

正确答案：D。去甲肾上腺素

解析：去甲肾上腺素的不良反应有：局部组织缺血坏死、急性肾功能衰竭（D对）、停药后的血压下降。